排列全口义齿人工牙的美观原则不包括
A. 牙弓弧度要与颌弓型一致
B. 上前牙的位置要衬托出上唇丰满度
C. 前牙排成浅覆（牙合）、浅覆盖
D. 要体现患者的个性
E. 上前牙的排列要参考患者的意见

正确答案：C。前牙排成浅覆（牙合）、浅覆盖

解析：美观原则：①牙弓型要与颌弓型协调一致。通常情况下颌弓型与面型一样也有方圆型、尖圆型和卵圆型三种。
②上前牙的位置要衬托出上唇丰满度，要达到此要求有以下几点可作参考：①上前牙唇面至切牙乳突中点一般8～10mm；②年轻人，上尖牙顶连线通过切牙乳突中点，而老年人上尖牙顶连线与切牙乳突后缘平齐；③上尖牙的唇面通常与腭皱的侧面相距10.5±1mm；④上前牙切缘在唇下露出2mm，年老者露的较少。
③牙齿排列要体现患者的个性。除前述选牙时要根据患者面型、年龄、肤色、颌弓大小选牙外，在排牙时要注意每个患者的不同特点。
④上前牙的排列要参考患者的意见，一般情况下，上前牙排列要在患者参与下完成。掌握“全口义齿排牙及蜡型试戴”知识点。